大腿内侧群肌叙述错误的是
A. 起自坐骨支、耻骨支前面
B. 5块肌分为浅、深层
C. 大部分止于股骨后面
D. 内收髋关节
E. 使髋关节旋内

正确答案：E。使髋关节旋内

解析：大腿内侧群肌起自坐骨支、耻骨支前面（A对），5块肌分为浅、深层（B对），大部分止于股骨后面（C对），内收髋关节（D对），使髋关节旋外，而非旋内（E错，为本题正确答案）。